协助诊断肾挫伤，首要的检查是
A. 血肌酐
B. 尿常规
C. 静脉尿路造影
D. 腹部CT平扫
E. 血细胞比容

正确答案：D。腹部CT平扫

解析：肾挫伤损伤仅局限于部分肾实质，形成肾瘀斑和（或）包膜下血肿，肾包膜及肾盂肾盏黏膜完整。腹部CT平扫（D对）可清晰显示肾皮质裂伤、尿外渗和血肿范围，以及肾组织有无活力，为肾损伤的首选检查。血肌酐（A错）主要用于监测肾功能，对肾挫伤意义不大。肾挫伤一般不会引起大出血，损伤涉及肾集合管可有少量血尿，故尿常规（B错）、血细胞比容（E错）对肾挫伤诊断价值不大。静脉尿路造影（C错）也可发现肾有无损伤及损伤的范围程度，但临床一般不作为首选。